肝与脾在生理功能上的联系有
A. 肝主疏泄，助脾运化
B. 脾化生气血，肝能藏血
C. 脾气健运，肝木得养
D. 肝藏血，脾统血，参与血的循行
E. 肝旺横逆犯胃

正确答案：A、B、C、D。肝主疏泄，助脾运化；脾化生气血，肝能藏血；脾气健运，肝木得养；肝藏血，脾统血，参与血的循行

解析：本题考查的是肝与脾的关系。肝与脾在生理功能上的联系有肝主疏泄，助脾运化（A对）、脾化生气血，肝能藏血（B对）脾气健运，肝木得养（C对）与肝藏血，脾统血，参与血的循行（D对）。肝与脾的关系，主要表现在饮食物的消化和血液生成、贮藏及运行方面。1.饮食物的消化：脾的运化有赖于肝的疏泄调节。肝疏泄功能正常，则脾的运化功能健旺，饮食方能正常消化。脾气健运，水谷之精微化源充盛，方能滋养肝体，肝木得养，疏泄功能方能正常发挥。2.血液的生成、贮藏和运行：肝主疏泄而维持血行，藏血而调节血量、防止出血；脾生血、统血，又为气血生化之源。肝旺横逆犯胃（E错）为肝与胃的关系。肝能协调脾胃升降：肝调畅气机，协调脾之升清与胃之降浊，维持正常的消化吸收功能。若肝疏泄功能失常，可影响胃气降浊，致胃失通降、胃气上逆，见纳呆、脘胀、嗳气、呕吐、便秘等，称为“肝胃不和”或“肝气犯胃”。